与侵袭性牙周炎关系最密切的致病菌是
A. 牙龈卟啉单胞菌
B. 伴放线放线杆菌
C. 中间普氏菌
D. 具核梭杆菌
E. 变形链球菌

正确答案：B。伴放线放线杆菌

解析：伴放线聚集杆菌（伴放线放线杆菌）是侵袭性牙周炎的主要致病菌。掌握“侵袭性牙周炎”知识点。